CO中毒时下列哪项是不正确的
A. 老人和孩子易患
B. 老人应与脑血管意外鉴别
C. 严重中毒血液COHb浓度可高于50%
D. 应立即原地抢救
E. 迟发脑病恢复较慢

正确答案：D。应立即原地抢救

解析：CO中毒的严重程度与中毒前患者身体状况有关，老人和孩子机体耐受性较差，较易出现中毒表现（A对）。CO中毒严重者可出现精神神经障碍，此时应与多种疾病相鉴别，老年病人应与脑血管疾病鉴别（B对）。按照中毒程度，CO中毒可分为三级，重度中毒患者血COHb浓度可高于50%（C对）。CO中毒现场急救首先采取的是撤离现场，终止CO继续吸入，然后再进行吸氧等其他治疗措施，而不能在原地抢救（D错，为本题正确答案）。CO中毒迟发性脑病已发生脑实质损伤，恢复较慢。